下列关于角质细胞棘细胞层叙述错误的是
A. 位于粒层的深部、细胞体积大
B. 由增生的基底细胞发育而来
C. 构成桥粒的蛋白质主要有桥粒芯蛋白和桥粒胶蛋白
D. 胞质常伸出许多小的刺状突起
E. 细胞多呈四边形

正确答案：E。细胞多呈四边形

解析：棘细胞层：位于粒层的深部，细胞体积大，多边形，由增生的基底细胞发育而来，胞质常伸出许多小的刺状突起，称细胞间桥。在透射电镜下观察，细胞间桥的突起相连为桥粒。构成桥粒的蛋白质主要有桥粒芯蛋白和桥粒胶蛋白。它们是一组跨膜蛋白，在黏膜上皮细胞间的黏附上起重要作用。在某些疾病如寻常性天疱疮，钙依赖性桥粒芯蛋白3成为自身抗原，诱发产生自身抗体，桥粒的结构受到破坏，上皮形成疱性病变。掌握“口腔黏膜基本结构”知识点。